关于《药品经营质量管理规范》的说法错误的是
A. 医疗机构药房和计划生育技术服务机构应按照《药品经营质量管理规范》对药品采购、储存、养护进行质量管理
B. 《药品经营质量管理规范》是药品经营管理和质量控制的基本准则
C. 药品生产企业销售药品、药品流通过程中其他涉及储存与运输药品的，也应当符合《药品经营质量管理规范》的规定
D. 《药品经营质量管理规范》附录作为正文的附加条款，与正文条款具有同等效力

正确答案：A。医疗机构药房和计划生育技术服务机构应按照《药品经营质量管理规范》对药品采购、储存、养护进行质量管理

解析：本题考查的是药品经营质量管理规范。《药品经营质量管理规范》（GSP）是药品经营管理和质量控制的基本准则，其目的是通过药品流通的全过程质量管理，规范药品经营行为，保障人体用药安全、有效（A错，为本题正确答案）。《药品经营质量管理规范》（GSP）是药品经营管理和质量控制的基本准则（B对），其目的是通过药品流通的全过程质量管理，规范药品经营行为，保障人体用药安全、有效。药品经营质量管理规范总体要求：药品GSP是为保证药品在流通全过程中始终符合质量标准，依据《药品管理法》等法律法规制定的针对药品采购、购进验收、储存运输、销售及售后服务等环节的质量管理规范，其核心是要求企业通过严格的质量管理制度来约束自身经营相关行为，对药品流通全过程进行质量控制。药品上市许可持有人、药品经营企业应当严格执行药品GSP，依法从事药品经营活动，拒绝任何虚假欺骗行为，在药品采购、储存、销售、运输等环节采取有效的质量控制措施，并采取有效的质量控制措施，确保药品质量，并按照国家有关要求，建立药品追溯体系，实现药品可追溯。同时，药品流通过程中其他涉及储存与运输药品的参与方，也应当符合药品GSP的相关要求（C对）。药品经营质量管理规范附录文件主要内容：根据监管要求，原国家食品药品监督管理总局针对药品经营企业信息化管理、药品储运温湿度自动监测、药品验收管理、药品冷链物流管理、零售连锁管理等具体要求，发布了《冷藏、冷冻药品的储存与运输管理》《药品经营企业计算机系统》《温湿度自动监测》《药品收货与验收》与《验证管理》等五个药品GSP附录，作为正文的附加条款配套使用。药品GSP附录与正文条款具有同等效力（D对）。